浅表的隐裂，无明显症状，且牙髓活力正常者，其治疗应首选
A. 开髓失活
B. 全冠修复
C. 备洞充填
D. 调（牙合）治疗
E. 拔除患牙

正确答案：D。调（牙合）治疗

解析：本题考查牙隐裂的防治原则。创伤是牙隐裂的病因，在治疗牙隐裂时，首先应消除病因，即浅表、无明显症状的隐裂，其治疗应首选调（牙合）治疗（D对），排除（牙合）干扰，降低牙尖斜度以减小劈裂力量，保护患牙。裂线达牙本质浅层、中层时可以沿裂线备洞，进行充填治疗（C错）。裂线达到牙本质深层时，可能累及牙髓，应做牙髓治疗，牙髓治疗过程中牙体硬组织会被进一步削弱，治疗完毕后要及时作全冠修复（B错）。全部治疗结束后，若患牙咬合痛不能控制，牙周反复肿胀，甚至出现窦道，应考虑拔除患牙（E错）。失活法用于去髓治疗麻醉效果不佳或对麻醉剂过敏的患者（A错）。